性温燥，阴虚燥咳者不宜的药物是
A. 旋覆花
B. 款冬花
C. 紫菀
D. 白芥子
E. 杏仁

正确答案：D。白芥子

解析：该题考查白芥子的药性和使用注意。白芥子味辛，性温，辛温走散，耗气伤阴，久咳肺虚及阴虚火旺者忌用（D对）。